医师在执业活动中，有下列行为之一的，由县级以上人民政府卫生行政部门给予警告或者责令暂停6个月以上1年以下执业活动，情节严重的，吊销其执业证书，除了
A. 由于不负责任延误急危病重患者的抢救和诊治，造成严重后果的
B. 未经亲自诊查、调查，签署诊断、治疗或者出生、死亡等证明文件的
C. 使用未经批准使用的药品、消毒药剂和医疗器械的
D. 未经批准擅自开办医疗机构行医或者非医师行医的
E. 隐匿、伪造或者擅自销毁医学文书及有关资料的

正确答案：D。未经批准擅自开办医疗机构行医或者非医师行医的

解析：未经批准擅自开办医疗机构行医或者非医师行医的，由县级以上人民政府卫生行政部门予以取缔，没收其违法所得及其药品、器械，并处10万元以下的罚款；对医师吊销其执业证书；给患者造成损害的，依法承担赔偿责任；构成犯罪的，依法追究刑事责任。掌握“医师执业规则及培训、考核及法律责任”知识点。